口腔中的主要致龋菌是
A. 变形链球菌
B. 中间普氏菌
C. 伴放线聚集杆菌
D. 唾液链球菌
E. 以上都不是

正确答案：A。变形链球菌

解析：本题考查口腔中的主要致龋菌。口腔变异链球菌是目前公认的最主要的致龋菌（A对E错）。中间普氏菌、伴放线聚集杆菌属于牙周致病菌。中间普氏菌是妊娠期龈瘤的优势菌（B错）。国外大量的研究表明伴放线放线杆菌（C错）（现称伴放线聚集杆菌）是侵袭性牙周炎的主要致病菌。唾液链球菌属于口腔正常菌群，对人类无致龋性（D错）。